易位型21-三体综合征最常见的核型是
A. 46，XY，-13，+t（13q21q）
B. 46，XY，-21，+t（21q21q）
C. 46，XY，-22，+t（21q22q）
D. 46，XY，-14，+t（14q21q）
E. 46，XY，-15，+t（15q21q）

正确答案：D。46，XY，-14，+t（14q21q）

解析：21-三体综合征根据核型分析可分为三型：标准型、易位型、嵌合体型。标准型约占患儿总数的95%左右，核型为47，XX（或XY），+21。易位型约占2.5%-5%，染色体总数46条，其中一条是额外的21号染色体的长臂与一条近端着丝粒染色体长臂形成的易位染色体，即发生于近着丝粒染色体的相互易位，称为罗伯逊易位常见核型为46，XY，-14，+t（14q21q）（D对）。嵌合体型约占2%-4%，存在着两种细胞系，一种为正常细胞，一种为21-三体细胞，形成嵌合体，其核型为46，XY（或XX）/47，XY（或XX），+21。